临床实践中，谁有权优先获取可供移植的器官，优先考虑的因素中除外
A. 医学标准
B. 捐献意愿
C. 移植的科研价值
D. 捐献事实
E. 登记时序

正确答案：C。移植的科研价值

解析：在临床实践中，谁有权优先获取可供移植的器官，一般可考虑以下因素：1.医学标准；2.捐献意愿；3.捐献事实；4.登记时序；5.年龄因素；还有一些其他因素，如“受者的家庭地位及作用”、“受者的社会价值”、“受者的经济支付能力”、“移植的科研价值”、“受者等待的时间”、“移植后的余年寿命”等只能作为辅助因素，不能作为优先选择的标准。掌握“人体器官移植伦理”知识点。